心理测评的参考指标
A. 作品
B. 信度
C. 效度
D. 误差
E. 常模

正确答案：E。常模

解析：目前大多数标准化测验采用标准分常模（E对）。心理测验的标准化目标是减少测量误差，使测量结果可靠和有效（D错）。